增生性肠结核患者不经常出现的临床表现是
A. 腹泻
B. 便秘
C. 腹痛
D. 腹部包块
E. 发热

正确答案：A。腹泻

解析：增生性肠结核即增生型肠结核，由于病变部位有大量结核肉芽肿和纤维组织增生，使肠壁增厚、僵硬，可使肠腔狭窄，引起梗阻，导致便秘的发生（B错）。腹泻（A对）常见于溃疡型肠结核，增生型肠结核少见。腹痛（C错）为肠结核的常见症状，在溃疡型肠结核和增生型肠结核中均常见。腹部包块（D错）多见于增生型肠结核。发热（E错）属于结核毒血症状，多见于溃疡型肠结核，增生型肠结核一般无明显结核毒血症状（P368），但是肠结核多伴有肠外结核病灶，也可引起发热症状。